社区保健服务的对象是
A. 患者
B. 老人
C. 儿童
D. 妇女
E. 社区成员

正确答案：E。社区成员

解析：本题考查社区保健服务的对象。社区保健服务的对象是社区内的全体成员（E对ABCD错），根据社区人群的基本情况，可将其分为五大类：健康人群、亚健康人群、高危人群、重点保健人群和病人。